提取分离叶绿素用的容剂
A. 水
B. 甲醇
C. 乙醇
D. 乙酸乙酯
E. 甲醚

正确答案：C。乙醇

解析：本题考查的是叶绿素的提取分离。提取分离叶绿素用的溶剂乙醇（C对）。在浓缩乙醇提取液中加入数倍量水稀释，放置以沉淀除去树脂、叶绿素等水不溶性杂质达到分离目的的方法称为醇提水沉法（醇/水法）等。苷类化合物一般可溶于水（A错）、甲醇（B错）、乙醇和含水的正丁醇中，难溶于石油醚、苯、三氯甲烷、乙醚等非极性有机溶剂，但碳苷较为特殊，在水或其他溶剂中的溶解度都很小。芦丁的溶解度可溶于乙醇、冰乙酸、乙酸乙酯等（D错）。